生产、销售假药、致人死亡或对人体健康造成其他特别严重情节的
A. 处十年以上有期徒刑、无期徒刑或死刑，并处以罚金或没收财产
B. 处十年以上有期徒刑、无期徒刑，并处以罚金或没收财产
C. 处七年以下有期徒刑、并处以罚金
D. 处二年以上七年以下有期徒刑，并处以罚金
E. 处七年以上有期徒刑或者无期徒刑，并处以罚金或没收财产

正确答案：A。处十年以上有期徒刑、无期徒刑或死刑，并处以罚金或没收财产

解析：本题考查生产、销售、提供假药的刑事责任。生产、销售假药、致人死亡或对人体健康造成其他特别严重情节的处十年以上有期徒刑、无期徒刑或死刑，并处以罚金或没收财产（A对）。根据《刑法》第一百四十一条规定，生产、销售假药的，处三年以下有期徒刑或者拘役，并处罚金；对人体健康造成严重危害或者有其他严重情节的，处三年以上十年以下有期徒刑，并处罚金；致人死亡或者有其他特别严重情节的，处十年以上有期徒刑、无期徒刑或者死刑，并处罚金或者没收财产。